人类精子库的伦理原则不包括
A. 保密原则
B. 平等原则
C. 社会公益原则
D. 保护后代的原则
E. 伦理监督的原则

正确答案：B。平等原则

解析：人类精子库的伦理原则：有利于供受者的原则、知情同意的原则、保护后代的原则、社会公益原则、保密原则、严防商业化的原则、伦理监督的原则。掌握“人类生殖技术伦理”知识点。